《中国药典》一部规定，黄芩薄层色谱鉴别所用的对照品是
A. 黄芩苷
B. 黄芩素
C. 汉黄芩苷
D. 汉黄芩素
E. 木蝴蝶苷

正确答案：A。黄芩苷